对注射给药的蛋白质多肤类药物没有稳定作用的是
A. 缓冲剂
B. 矫味剂
C. 糖和多元醇类
D. 大分子化合物
E. 氨基酸

正确答案：B。矫味剂